选用治疗急性坏死性溃疡性牙龈炎最敏感的抑菌药物是
A. 四环素
B. 金霉素
C. 磺胺类
D. 甲硝唑
E. 青霉素

正确答案：D。甲硝唑

解析：本题考查急性坏死性溃疡性龈炎的治疗。选用治疗急性坏死性溃疡性牙龈炎最敏感的抑菌药物是甲硝唑（D对）。急性坏死性龈炎是由梭形杆菌和螺旋体引起的特殊感染，梭形杆菌和螺旋体均属于厌氧菌。甲硝唑是常用于治疗厌氧菌感染的药物，能显著减少牙菌斑中的螺旋体、梭杆菌等，改善牙龈出血、牙周袋溢脓等症状。四环素、金霉素（AB错）为四环素类广谱抗生素，长期服用会产生耐药菌株或导致菌群失调，造成叠加感染，故一般不使用。当磺胺类（C错）与细菌反复接触后，细菌对药物敏感性降低甚至消失，且易产生抗药性。青霉素类药物（E错）属于β—内酯胺类抗生素，对能产生β—内酯胺类的细菌无效，故不用于治疗急性坏死性溃疡性牙龈炎。